急性心肌梗死静脉滴注硝酸甘油的起始剂量是
A. 10～20μg/min
B. 30～40μg/min
C. 50～70μg/min
D. 80～90μg/min
E. 100～200μg/min

正确答案：A。10～20μg/min

解析：急性心肌梗死患者可应用硝酸甘油，扩张冠状动脉和外周血管，使用时从10～20ug/min（A对BCDE错）开始静脉滴注。每分钟增加5～10μg/min直至左室充盈压下降。